维生素D缺乏性手足抽搐症的发病机制与维生素D缺乏性佝偻病最根本的不同在于
A. 神经系统兴奋性较髙
B. 甲状旁腺反应迟钝，甲状旁腺激素代偿不足
C. 食物中钙含量过低
D. 维生素D缺乏的程度较重
E. 食物中磷含量过高

正确答案：B。甲状旁腺反应迟钝，甲状旁腺激素代偿不足

解析：维生素D缺乏，小肠吸收钙磷减少，血钙降低，甲状旁腺反应正常情况时，PTH（甲状旁腺激素）代偿性分泌增多，破骨细胞作用增强，血钙恢复；反之，若甲状旁腺反应迟钝，甲状旁腺激素代偿不足（B对），血钙进一步降低，神经肌肉兴奋性增加（A错），出现手足抽搐等症状。简言之，甲状旁腺激素正常情况下可通过“牺牲”骨的钙磷沉积，进而维持血钙稳定，以免引起惊厥、喉痉挛等严重的后果，这也是人体的一种自我保护机制。食物中钙含量过低（C错）、维生素D缺乏程度较重（D错）、食物中的磷含量过高（E错）可能会引起不同程度的低血钙，但只要甲状旁腺代偿完全，就不会引起手足抽搐。